局部应用治疗青光眼，作用较毛果芸香碱强而持久的药物是
A. 新斯的明
B. 毒扁豆碱
C. 阿托品
D. 碘解磷定
E. 氯磷定

正确答案：B。毒扁豆碱